达尔文发现，不同类的动物在相同的环境下有不同的性状；相同类的动物在不同的环境下，具有不同的性状，这类寻求因果关系的方法是
A. 求同法
B. 求异法
C. 同异共用法
D. 共变法

正确答案：C。同异共用法

解析：本题考查同异共求法的概念。同异共求法（C对ABD错）是指如果某被考察的现象出现的各种场合只有一个共同的因素（求同），而这个被考察的现象不出现的各个场合都没有这个共同的因素（求同），那么，这个共同的因素（多次求异）就是被考察现象的原因。在病因研究中，当患病个体中均具有而且只具有一个共同因素，非患病个体中均没有该因素，即患病组和非患病组相比，唯一区别就是该因素，那么该因素有可能是该病病因。